患者，男，20岁。左踝部疼痛，行走时加重，喜温热，舌苔白，脉弦紧。治疗应首选
A. 申脉、照海、昆仑、丘墟
B. 悬钟、照海、丘墟、三阴交
C. 太溪、昆仑、阳陵泉、解溪
D. 太冲、太溪、照海、悬钟
E. 昆仑、悬钟、阴陵泉、申脉

正确答案：A。申脉、照海、昆仑、丘墟

解析：该患者为年轻男性，左踝部疼痛，行走时加重，无其他病史与症状，故考虑当局部的软组织损伤来治疗，以局部的穴位为主，故取踝部的申脉、照海、昆仑、丘墟（A对）。悬钟、三阴交距踝部较远，不为首选（B错）。太溪、阳陵泉同样距踝部较远，不为首选（C错）。太冲、太溪、悬钟距离踝部较远，不做首选（D错）。悬钟、阴陵泉距离踝部较远，无治踝部疼痛之功（E错）。